丙型肝炎曾经最主要传播途径是
A. 输血
B. 性交
C. 粪-口途径
D. 日常生活接触
E. 母婴传播

正确答案：A。输血

解析：丙型肝炎主要通过输血（A对）及血制品传播；使用非一次性注射器和针头，使用未经严格消毒的牙科器械、内镜，创伤性操作，共用牙刷或剃刀，文身及穿耳洞等时，通过破损的皮肤或黏膜传播HCV；也可通过性交传播（B错）、母婴传播（E错），但这两种不是主要传播途径。